通常会出现口腔病损的是哪一类天疱疮
A. 增殖型天疱疮
B. 寻常型天疱疮
C. 落叶型天疱疮
D. 大疱型类天疱疮
E. 红斑型天疱疮

正确答案：B。寻常型天疱疮

解析：本题考查天疱疮。通常会出现口腔病损的是寻常型天疱疮（B对）。天疱疮一种慢性的皮肤-黏膜自身免疫性大疱性疾病，临床上根据皮肤损害特点可以分为寻常型、增殖型（A错）、落叶型（C错）、红斑型（E错），其中寻常型在口腔黏膜病损中最为常见，约有70%的患者，口腔是最早损害的部位。大疱性类天疱疮皮肤损害多见于易受摩擦的部位，口腔黏膜少见（D错）。